意志通过什么途径对人的健康产生影响
A. 影响自我暗示
B. 影响人的思维方式
C. 影响人的个性特征
D. 影响需要和动机强度
E. 影响认知过程和情绪过程

正确答案：E。影响认知过程和情绪过程

解析：认知过程是意志活动的前提和基础。意志过程受到情绪过程的影响。掌握“意志过程”知识点。